药物分子结构中引入手性中心后，得到的对映异构体，成为手性药物。这些药物的对映异构体之间在生物活性上有时存在很大的差别。下列药物中，属于手性药物的是
A. 氯胺酮
B. 乙胺丁醇
C. 氨氯地平
D. 普鲁卡因
E. 阿司匹林

正确答案：A、B、C。氯胺酮；乙胺丁醇；氨氯地平

解析：本题考查药物的手性特征及其对药物作用的影响。氯胺酮（A对）是手性药物，有两个异构体，（+）-（S）-对映体具有麻醉作用，而（-）-（R）-对映体可产生中枢兴奋作用。抗结核病药乙胺丁醇（B对），分子中含有2个手性中心，但两个手性碳是相同的且分子是对称的，所以只有3个光学异构体。氨氯地平（C对）含一个手性碳，属于手性药物。普鲁卡因（D错）和阿司匹林（E错）不是手性药物。